胆固醇合成的关键酶是
A. 脂酰CoA合成酶
B. HMG-CoA合酶
C. 脂酰CoA脱氢酶
D. HMG-CoA还原酶
E. 丙酮酸羧化酶

正确答案：D。HMG-CoA还原酶

解析：合成胆固醇的基本原料是乙酰CoA，并需ATP供能，NADPH+H+供氢。胆固醇合成的关键酶是HMG-CoA还原酶。掌握“甘油磷脂、胆固醇和血脂蛋白代谢”知识点。